肝与志液体华窍的关系，正确的是
A. 在志为怒
B. 在液为泪
C. 在体为脉
D. 在华为爪
E. 在窍为目

正确答案：A、B、D、E。在志为怒；在液为泪；在华为爪；在窍为目

解析：本题考查的是肝与志、液、体、华、窍的关系。肝与志液体华窍的关系，正确的是在志为怒（A对）、在液为泪（B对）、在华为爪（D对）与在窍为目（E对）。肝与志、液、体、华、窍的关系：1.肝在志为怒；2.肝在液为泪；3.肝在体合筋，其华在爪；4.肝在窍为目。在体合脉（C错）为心。心与志、液、体、华、窍的关系：1.心在志为喜；2.心在液为汗；3.心在体合脉，其华在面；4.心在窍为舌。